下列哪项不是血虚的主要表现
A. 手足发麻
B. 面色青黑
C. 心悸多梦
D. 头晕眼花
E. 月经衍期

正确答案：B。面色青黑

解析：血液亏虚，不能濡养头目，上荣舌面，故面色淡白或萎黄，口唇、眼睑色淡，头晕眼花（D对）；血虚心失所养则心悸，神失滋养则失眠多梦（C对）；血少不能濡养筋脉、肌肤，故手足麻木（A对），爪甲色淡；女子以血为用，血虚致血海空虚，冲任失充，故月经量少色淡、衍期（E对）甚或闭经；舌淡苔白、脉细无力均为血虚之象。面色青黑多见于寒证（B错，为本题正确答案）。